指出药物的物理常数缩写：E1%1cm
A. 百分吸收系数
B. 比旋度
C. 折光率
D. 熔点
E. 沸点

正确答案：A。百分吸收系数

解析：本题考查药品检验常用参数。指出药物的物理常数缩写：E1%1cm指百分吸收系数（A对）。百分吸收系数是指一定波长下，吸光物质的溶液浓度为1g/100ml(1%)，液层厚度为1cm时，溶液的吸光度。比旋度（B错）以[α]tD表示。折光率（C错）以ntD表示。熔点（D错）以m.p表示。沸点（E错）以b.p表示。